男，68岁。间断发热1个月，咳血伴进行性少尿10天。查体：BP165/100mmHg，双中下肺可闻及湿性啰音，双下肢水肿。尿常规：RBC40～50/HP，蛋白（++）。血Cr455μmol/L，BUN18.5mmol/L，B超示双肾增大。ANA（-），抗中性粒细胞胞浆抗体阳性。最可能的诊断是
A. 急进性肾小球肾炎Ⅱ型
B. 急进性肾小球肾炎Ⅲ型
C. 急进性肾小球肾
D. IgA肾病
E. 急进性肾小球肾炎Ⅰ型

正确答案：B。急进性肾小球肾炎Ⅲ型

解析：患者老年男性，间断发热1个月（提示患者可能有感染史），咳血伴进行性少尿10天，血Cr455μmol/L【正常值（男）44～133μmol/L】（提示患者肾功能严重受损），BUN18.5mmol/L（正常值2.86～7.14mmol/L），B 超示双肾增大，诊断为急进性肾小球肾炎。患者抗中性粒细胞胞浆抗体阳性，则患者最可能的诊断是急进性肾小球肾炎Ⅲ型（B对）。